医疗机构违反规定，诊疗活动超出登记范围的，由县级以上人民政府卫生行政部门予以警告，责令其改正，并
A. 1千元以下罚款
B. 3千元以下罚款
C. 5千元以下罚款
D. 8千元以下罚款
E. 吊销《医疗机构执业许可证》

正确答案：B。3千元以下罚款

解析：医疗机构违反规定，诊疗活动超出登记范围的，由县级以上人民政府卫生行政部门予以警告，责令其改正，并可以根据情节处以3千元以下的罚款，情节严重的，吊销其《医疗机构执业许可证》。掌握“医疗机构登记和校验及法律责任”知识点。